系统性红斑狼疮的主要临床表现是
A. 育龄女性多发
B. 皮肤黏膜与关节表现
C. 肾炎
D. 浆膜炎
E. 贫血

正确答案：B。皮肤黏膜与关节表现

解析：本题考查系统性红斑狼疮。SLE中，80%在病程中出现皮疹、关节痛是常见症状（B对）。有临床表现的肾炎占60%。半数以上急性发作期出现浆膜炎。